某溶液的pH值约为6，用酸度计测定其精密pH时，应选择的两个标准缓冲液的pH值是
A. 1.68，4.00
B. 5.00，6.86
C. 4.00，6.68
D. 6.86，9.18
E. 1.68，6.86

正确答案：C。4.00，6.68